分散相质点以多分子聚集体（胶体微粒）分散于分散介质中形成的胶体分散体系，称为
A. 胶体溶液型液体药剂
B. 破裂
C. 起昙
D. 溶胶剂
E. 絮凝

正确答案：A。胶体溶液型液体药剂